男，55岁。2个月前出现吃干硬食物时候有梗噎感，喜软食，且梗噎感越来越明显。体检无阳性体征。钡餐造影见局限性食管管壁僵硬。化验检查无明显异常。应首先考虑
A. 食管憩室
B. 食管炎
C. 食管静脉曲张
D. 食管癌
E. 贲门失弛缓症

正确答案：D。食管癌

解析：中年男性患者，2个月前出现吃干硬食物时候有梗噎感，喜软食，且梗噎感越来越明显（中晚期食管癌的典型症状），钡餐造影见局限性食管管壁僵硬（食管癌患者钡餐造影典型表现），综合患者的临床表现及影像学检查，可诊断为食管癌（D对）。食管憩室（P279）（A错）钡餐造影可见钡影外溢呈憩室状。食管炎（B错）最常见典型的临床症状是反酸和烧心，胃镜下可见食管下段黏膜破损。食管静脉曲张（P424）（C错）多见于门静脉高压症，钡餐造影在食管为钡剂充盈时，可见曲张的静脉呈虫蚀状改变；排空时，曲张的静脉呈蚯蚓样或串珠状负影。贲门失弛缓症（P278）（E错）主要症状为间断性咽下困难、胸骨后沉重感或阻塞感，钡餐造影可见食管体部蠕动消失，食管下端及贲门部呈鸟嘴状，边缘整齐光滑。